弛张热是
A. 高热骤起持续数日后骤退，间歇无热数日，高热重复出现
B. 发热患者体温曲线无规律
C. 高热持续，24小时内体温波动不超过1℃
D. 24小时内体温波动超过2℃，但最低未达到正常水平
E. 24小时内体温波动于高热与正常体温之间

正确答案：D。24小时内体温波动超过2℃，但最低未达到正常水平

解析：弛张热：24小时内体温高低相差超过1℃，但最低点未达正常水平，可见于败血症、伤寒（缓解期）、肾综合征出血热（D对）。回归热：是指高热持续数天后自行消退，但数天后又再出现高热，可见于回归热、布鲁菌病等。若在病程中多次重复出现并持续数月之久时称为波状热（A错）。不规则热：是指发热患者的体温曲线无一定规律的热型，可见于流行性感冒、败血症等（B错）。稽留热：体温升高超过39℃且24小时内相差不超过1℃，可见于伤寒、斑疹伤寒等的极期（C错）。间歇热：24小时内体温波动于高热与正常体温之下，可见于疟疾、败血症等（E错）。